某妇女，52岁，绝经3年，要求防治骨质疏松，以下哪项不适用
A. 多饮牛奶
B. 多吃高脂肪食物
C. 多运动
D. 补充激素
E. 使用降钙素

正确答案：B。多吃高脂肪食物

解析：本题考查绝经后骨质疏松的防治。过多食用高脂肪食物（B错，为本题正确答案）进入身体出现堆积，容易增加体重，升高血脂水平。绝经后骨质疏松的防治：提高骨峰值：①摄入足够的钙：多饮牛奶（A对）；②加强体育锻炼，多运动（C对）；③生活方式，均衡饮食，倡导健康生活方式。减缓或阻止绝经后骨丢失：①钙剂，维生素D；②雌激素：围绝经期或绝经早期补充雌激素（D对）；③使用降钙素（E对）等。